对革兰阳性菌、革兰阴性菌、厌氧菌均有强大抗茵活性的药物是
A. 阿莫西林
B. 亚胺培南
C. 氨曲南
D. 克拉维酸
E. 替莫西林

正确答案：B。亚胺培南

解析：本题考查亚胺培南。亚胺培南（B对）为碳青霉烯类药物中的代表药，对革兰阳性菌、革兰阴性菌、需氧菌、厌氧菌均有很强的抗菌活性。阿莫西林（A错）为广谱青霉素类，主要作用于对青霉素敏感的革兰阳性菌以及部分革兰阴性杆菌如大肠埃希菌、奇异变形杆菌、沙门菌属、志贺菌属和流感嗜血杆菌等。氨曲南（C错）为单酰胺菌素类的代表药，对需氧革兰阴性菌作用强，尤其对肠杆菌科铜绿假单胞菌、流感嗜血杆菌及淋球菌作用强。克拉维酸（D错）为β-内酰胺酶抑制剂，本身只有较弱的抗菌活性，能与β-内酰胺酶牢固结合，生成不可逆结合物，抑制β-内酰胺酶，可与β-内酰胺类抗生素联合应用，增强药效。替莫西林（E错）为耐β-内酰胺酶的半合成青霉素类抗生素，对G⁻杆菌作用强，但对铜绿假单胞菌无效，对G⁺作用弱。